引起疱疹性咽峡炎的病原体是
A. 呼吸道合胞病毒
B. 腺病毒3、7型
C. 副流感病毒
D. 柯萨奇A组病毒
E. B族链球菌

正确答案：D。柯萨奇A组病毒

解析：柯萨奇A组病毒为疱疹性咽峡炎的病原体（D对）。呼吸道合胞病毒是毛细支气管炎的主要病原体（A错）。腺病毒3、7型为咽结合膜热的病原体（B错）。流感病毒、副流感病毒引起流行性感冒（C错）。B族溶血性链球菌可引起脑膜炎和新生儿败血症，国外多见（E错）。